患者，男，42岁，因非小细胞肺癌使用铂类药物化疗，同时给予止吐药物、升白细胞药物和水化治疗。该患者可选用的铂类化疗药物是
A. 顺铂、奥沙利铂
B. 卡铂、奥沙利铂
C. 顺铂、卡铂
D. 依托泊苷、奥沙利铂
E. 顺铂、依托泊苷

正确答案：C。顺铂、卡铂

解析：本题考查铂类药物化疗。破坏DNA的铂类化疗药物包括：顺铂、卡铂（C对）、奥沙利铂、奈达铂等。